在痛风发作的急性期，应当首选的抗痛风药是
A. 秋水仙碱
B. 二氟尼柳
C. 苯溴马隆
D. 别嘌醇
E. 阿司匹林

正确答案：A。秋水仙碱

解析：本题考查急性痛风的首选治疗药。痛风的药物治疗：（1）急性发作期应控制关节炎症、抑制粒细胞浸润和白细胞趋化或减少细胞坏死，常用非甾体抗炎药（阿司匹林（E错）及水杨酸钠禁用）和秋水仙碱（A对）；（2）缓解期尽快排酸和抑制尿酸合成。在痛风性关节炎的急性炎症症状消失后应用抑酸药别嘌醇（D错）；（3）慢性期应长期（乃至终身）抑制尿酸合成，并用促进尿酸排泄药（促使尿酸通过肾脏排泄的苯溴马隆（C错）和丙磺舒）；（4）当急性发作期、病情突然加重或侵犯新关节时，应及时给予非甾体抗炎药或秋水仙碱。二氟尼柳（B错）主要用于轻、中度疼痛的镇痛。